女，37岁。发作性喘息2年，查体：双肺满布哮鸣音。X线片未发现异常。应首先采取的治疗措施是
A. 吸入糖皮质激素
B. 口服抗过敏药物
C. 静脉点滴抗生素
D. 使用支气管舒张剂
E. 无创通气

正确答案：D。使用支气管舒张剂

解析：患者为青年女性，发作性喘息，双肺满布哮鸣（为支气管哮喘的典型表现），X线片未发现异常，初步诊断为支气管哮喘急性发作，应采取的治疗措施是应用缓解性药物：①短效β₂受体激动剂（SABA：为治疗哮喘急性发作的首选药）（D对）；②短效吸入型抗胆碱能药物（SASM）；③短效茶碱；④全身应用糖皮质激素。吸入糖皮质激素（A错）以及口服抗过敏药物（B错）是哮喘控制性治疗措施。哮喘并非感染性疾病，无需应用抗生素（C错）。无创通气（E错）适用于并发严重的呼吸衰竭。